妇女一生各个阶段中，哪个阶段历时最长
A. 新生儿期
B. 儿童期
C. 青春期
D. 性成熟期
E. 绝经后期

正确答案：D。性成熟期

解析：性成熟期是卵巢生殖功能与内分泌功能最旺盛时期。18岁开始，历时约30年，此期卵巢功能成熟，出现周期性排卵。掌握“女性生殖系统生理”知识点。